子宫内膜腺上皮细胞的核下开始出现含糖原小泡，相当于月经周期的
A. 增生期早期
B. 分泌期早期
C. 增生期中期
D. 分泌期中期
E. 增生期晚期

正确答案：B。分泌期早期

解析：子宫内膜腺上皮细胞的核下开始出现含糖原小泡，相当于月经周期的分泌早期（月经周期第15～19日）（B对）。增生期早期（A错）为月经的第5～7日，此期的子宫内膜薄，腺体短、直、细且稀疏，腺上皮细胞呈立方形或低柱状。增生期中期（C错）为月经周期的第8～10日，此期的内膜腺体数增多、伸长并稍有弯曲，腺上皮细胞增生活跃呈柱状，开始有分裂相。增生期晚期（E错）是月经周期的第11～14天，此期的子宫内膜进一步增厚，表面高低不平，略呈波浪形，腺上皮变为高柱状，腺体更长，形成弯曲状。分泌期中期（D错）是月经周期的第20～23日，此期的子宫内膜较前更厚并呈锯齿状，腺体内的分泌上皮细胞顶端胞膜破裂，细胞内糖原溢入腺体，称顶浆分泌。分泌期晚期是月经周期的第24～28日，此期的子宫内膜呈海绵状腺体开口面向宫腔，有糖原等分泌物溢出（P22）。